下列属于心力衰竭的常见病因的是
A. 水电解质紊乱
B. 肺部感染
C. 感染
D. 冠状动脉粥样硬化性心脏病
E. 洋地黄用量不当

正确答案：D。冠状动脉粥样硬化性心脏病

解析：冠状动脉粥样硬化性心脏病（D对）导致缺血性心肌损害如心肌梗死、慢性心肌缺血，属于心力衰竭的常见病因。水电解质紊乱（A错）、肺部感染（B错）、感染（C错）、洋地黄用量不当（E错）属于心力衰竭的诱因。